关于经济因素对健康的影响，不正确的说法是
A. 经济因素对健康的影响是多方面的
B. 单纯注重经济增长将危害人类的健康
C. 人群收入的绝对水平决定着经济对健康的影响程度
D. 经济的发展应与社会发展及促进人类健康水平同步
E. 人群的健康水平影响经济的发展

正确答案：C。人群收入的绝对水平决定着经济对健康的影响程度

解析：在社会因素中，社会经济因素对健康的影响起主导作用，经济发展水平对健康的影响是决定性的、基础性的（C项错误），社会经济因素通过其他社会因素如工作、生活条件、营养状况、教育、卫生服务等影响人群的健康水平（A项正确）发展中国家与发达国家的疾病谱死亡谱有明显的差异，主要原因是经济发展水平不同（D项正确），现代工业促进社会经济发展同时也给人类健康带来了不利影响，如环境污染等（B、D项正确），人群健康水平提高，可减少劳动者因病缺勤，增加国民收入，人民健康水平提高了，意味着劳动力质量提高，又能促进经济水平发展（E项正确）。